男，19岁。咽痛、发热伴咳嗽2周，眼睑水肿伴肉眼血尿3天。查体：BP150/100mmHg，全身皮肤无皮疹。实验室检查：尿蛋白（++），尿红细胞30～40/HP，管型3～5/LP，补体C₃降低，SCr126μmol/L。该患者最可能出现的管型是
A. 上皮细胞管型
B. 透明管型
C. 红细胞管型
D. 白细胞管型
E. 蜡样管型

正确答案：C。红细胞管型

解析：尿中管型的出现表示蛋白质或细胞成分在肾小管内凝固、聚集，其形成与尿蛋白的性质和浓度、尿液酸碱度以及尿量有密切关系，宜采集清晨尿标本做检查。肾小球或肾小管性疾病可引起管型尿，但在发热、运动后偶可见透明管型（B错），此时不一定代表肾脏有病变。但若有细胞管型或较多的颗粒管型与蛋白尿同时出现，则临床意义较大。红细胞管型（C对）见于急性肾小球肾炎；上皮细胞管型（A错）见于肾小管坏死；白细胞管型（D错）见于活动性肾盂肾炎、间质性肾炎；蜡样管型（E错）见于慢性肾小球肾炎。